类固醇激素不包括
A. 雌三醇
B. 糖皮质激素
C. 醛固酮
D. 雌二醇
E. 肾上腺素

正确答案：E。肾上腺素